新药审批并颁发新药证书属于
A. 药品的注册管理
B. 药品的生产管理
C. 药品的流通管理
D. 药品的使用管理
E. 药品的广告管理

正确答案：A。药品的注册管理

解析：本题考查药品的注册管理。新药审批并颁发新药证书属于药品的注册管理（A对）。药品注册，是指国家食品药品监督管理局根据药品注册申请人的申请，依照法定程序，对拟上市销售的药品的安全性、有效性、质量可控性等进行审查，并决定是否同意其申请的审批过程。药品注册申请，包括新药申请、仿制药申请、进口药品申请及其补充申请和再注册申请。